可以激活蛋白激酶A的是
A. IP₃
B. DG
C. cAMP
D. cGMP
E. PIP₂

正确答案：C。cAMP

解析：可以激活蛋白激酶A的是cAMP（C对）。因为细胞内信号传导有许多不同的通路，在蛋白激酶A这条通路中，激素→G蛋白→AC→cAMP→PKA→效应蛋白→生物学效应。在IP₃（A错）这条通路中，激素→G蛋白→PLC→IP₃→Ca²⁺→PKC→效应蛋白→生物学效应。在DG（B错）这条通路中，激素→G蛋白→PLC→DG→PKC→效应蛋白→生物学效应。在cGMP（D错）这条通路中，ANP→GC→cGMP→PKG→效应蛋白→生物学效应。